生长轨迹现象主要受哪一因素的影响
A. 遗传因素
B. 内分泌系统
C. 营养
D. 地理与气候
E. 疾病

正确答案：A。遗传因素

解析：本题考查影响体格生长的因素。遗传（A对BCDE错）是影响体格生长的重要因素，人体生长发育过程中，如果外界环境无特殊变化，人体生长发育通常比较稳定，呈鲜明的轨迹，其生长发育状况在所处人群中保持有限的上下波动幅度，这是一个特殊的动态和非常复杂的调控系统，遗传因素起到关键作用。